关于釉牙本质界处的小弧线的说法，正确的是
A. 位于牙釉质
B. 位于牙本质
C. 凹面向着牙釉质
D. 凹面向着牙本质
E. 小凹线间的嵴在冠部不明显

正确答案：C。凹面向着牙釉质

解析：釉牙本质界电镜扫描可见釉质形成许多弧形外突，与其相对的是牙本质表面的小凹，小凹间有突出的嵴，这些嵴在咬合力最大的冠部牙本质更突出。掌握“牙釉质”知识点。